女，43岁。左乳头溢液10余天。无不适症状。查体：乳房视诊无异常发现，未扪及肿块，无压痛，按压左乳晕外上方可见黄褐色溢液。门诊首选的检查是
A. 热图像检查
B. 钼靶X线摄片
C. B型超声检查
D. 溢液涂片细胞学检查
E. 近红外线扫描

正确答案：D。溢液涂片细胞学检查

解析：中年女性，乳头溢液，扪诊未及肿块，诊断考虑乳管内乳头状瘤。对于乳头溢液未扪及肿块患者，可作乳腺导管内视镜检查，乳头溢液涂片细胞学检查（D对），以排除有无乳腺癌。热图像检查（A错）系根据癌细胞代谢快，产热较周围组织高，液晶膜可将乳房表面温差变为肉眼可见的图像，从而显示热区肿瘤，可初步区分肿块的良恶性，而本例无肿块。钼靶X线摄片（B错）主要用于乳腺癌筛查。B型超声检查（C错）主要用于鉴别肿块系囊性还是实性。近红外线扫描（E错）为显示乳腺肿块的检查。